肺癌空洞的典型X线表现是
A. 薄壁空洞，形状不规则
B. 厚壁空洞，内壁光滑
C. 薄壁空洞，内壁光滑
D. 厚壁空洞，内壁凹凸不平
E. 厚壁空洞，内有液平

正确答案：D。厚壁空洞，内壁凹凸不平

解析：肺癌组织坏死与支气管相通后，表现为偏心的厚壁空洞，内壁凹凸不平（D对ABC错）。只有继发感染时，洞内才出现液平，这并不是典型表现（E错）。薄壁空洞，内壁光滑见（C错）于肺脓肿。